介绍新药，编写《医院药讯》等必须使药物信息
A. 紧密结合临床
B. 内容广泛多样
C. 更新传递快速
D. 做到去伪存真
E. 提高药学水平

正确答案：A。紧密结合临床